氟的急救量
A. 5.7mg
B. 5mg
C. 2.5mg
D. 10mg
E. 15mg

正确答案：E。15mg

解析：本题考查急性氟中毒。氟的急救量为15mg（E对）。可根据摄入剂量的不同分别采取以下救治方案：①当氟摄入量在5mgF⁻/kg以下时（C错），可服用一定量钙、铝、镁作为解毒剂；②当摄入氟量达到或超过5mgF⁻/kg（ABD错），应先迅速采用急救措施然后住院观察；③当服用氟量接近或超过15mgmgF⁻/kg，应采取紧急措施，立即将患者收入医院急诊室进行急救处理、心脏监护、抗休克疗法。